男，72岁。排便时突然跌倒，呼之不应。诊断为心脏骤停。有陈旧心肌梗死和糖尿病病史。心电图示心脏搏动停顿，首选药物
A. 氯丙嗪
B. 静脉输注硫酸氢钠
C. 5%葡萄糖酸钙
D. 肾上腺素
E. 利多卡因

正确答案：D。肾上腺素

解析：患者老年男性，心脏骤停诊断明确，此时抢救的关键尽早进行心肺复苏（CPR）和复律治疗。肾上腺素（九版药理学P81）（D对）可作用于心肌、传导系统和窦房结的β₁和β₂受体，加强心肌收缩性，加速传导，加快心率，提高心肌的兴奋性，有助于自主心律的恢复，是心肺复苏的首选药物。氯丙嗪（九版药理学P143）（A错）为中枢多巴胺受体的阻断剂，具有镇静、抗精神病、镇吐、降低体温及基础代谢等作用。硫酸氢钠（B错）具有强腐蚀性，临床上很少使用。5%葡萄糖酸钙（C错）可用于治疗高钾血症，防止高钾血症引起心脏骤停。利多卡因（P319）（E错）为心肺复苏时常用的抗心律失常药物。